药物分子中的16位为甲基，21位为羟基，该羟基可以与磷酸或琥珀酸成脂，进一步与碱金属成盐，增加水溶性，该药物是
A. 氢化泼尼松
B. 曲安西龙
C. 曲安奈德
D. 地塞米松
E. 氢化可的松

正确答案：D。地塞米松

解析：本题考查地塞米松的结构。地塞米松（D对）分子中的16位为甲基，21位为羟基，该羟基可以与磷酸或琥珀酸成脂，进一步与碱金属成盐，增加水溶性，是目前临床上应用最广泛的强效皮质激素。曲安奈德（C错）具有缩酮结构。在9α-位引入氟原子、C16引入羟基并与C17α-羟基一道制成丙酮的缩酮，可抵消9α-氟原子取代增加钠潴留作用，糖皮质激素作用大幅度增加，如曲安奈德。曲安西龙（B错）没有缩酮结构。天然存在的糖皮质激素是可的松和氢化可的松（E错）。可的松和氢化可的松的1位增加双键分别得到泼尼松和氢化泼尼松（A错），水钠潴留作用和排钾作用比可的松小，抗炎及抗过敏作用较强，副作用较少。